关于药物制剂与剂型的说法，错误的是
A. 药物剂型是药物的临床使用形式
B. 制剂处方中除主药外的所有物质统称为辅料
C. 改变剂型可能改变药物的作用性质
D. 注射剂、单剂量滴眼剂中均不得加入抑菌剂
E. 吸入制剂吸收速度快，几乎与静脉注射相当

正确答案：D。注射剂、单剂量滴眼剂中均不得加入抑菌剂

解析：本题考查药物的剂型与制剂。眼用液体制剂属多剂量剂型，要保证在使用过程中始终保持无菌，必须添加适当的抑菌剂（D错，为本题正确答案）。药物剂型是药物的临床使用形式（A对）。药用辅料是指生产药品和调配处方时所用的赋形剂和附加剂，是除了活性成分以外，包含在药物制剂中的在安全性方面已进行了合理评估的物质（B对）。剂型可以改变药物的作用性质（C对）。吸入制剂无首过效应，吸收速度快，几乎与静脉注射相当（E对）。